栀子药材的性状特征有
A. 呈长卵圆形或椭圆形，长1.5～3.5cm，直径1～1.5cm
B. 表面红黄色或棕红色，具6条翅状纵棱
C. 顶端残存萼片，基部稍尖，有残留果梗
D. 种子多数，集结成团，深红色或红黄色
E. 气芳香，味甜辣

正确答案：A、B、C、D。呈长卵圆形或椭圆形，长1.5～3.5cm，直径1～1.5cm；表面红黄色或棕红色，具6条翅状纵棱；顶端残存萼片，基部稍尖，有残留果梗；种子多数，集结成团，深红色或红黄色

解析：本题考查的是栀子药材的性状鉴别。栀子药材的性状特征有呈长卵圆形或椭圆形，长1.5～3.5cm，直径1～1.5cm（A对）、表面红黄色或棕红色，具6条翅状纵棱（B对）、顶端残存萼片，基部稍尖，有残留果梗（C对）与种子多数，集结成团，深红色或红黄色（D对）。栀子：【性状鉴别】药材呈长卵圆形或椭圆形，长1.5～3.5cm，直径1～1.5cm。表面红黄色或棕红色，具6条翅状纵棱，棱间常有1条明显的纵脉纹，并有分枝。顶端残存萼片，基部稍尖，有残留果梗。果皮薄而脆，略有光泽；内表面色较浅，有光泽，具2～3条隆起的假隔膜。种子多数，扁卵圆形，集结成团，深红色或红黄色，表面密具细小疣状突起。气微，味微酸而苦（E错）。